常用于治疗消渴口干腕部疼痛的腧穴是
A. 鱼际
B. 阳池
C. 照海
D. 中渚
E. 后溪

正确答案：B。阳池

解析：阳池属于手少阳三焦经腧穴，主治目赤肿痛、耳聋、喉痹等五官病证；消渴，口干；腕痛，肩臂痛（B对）。鱼际主治咳嗽、咯血、咽干、咽喉肿痛、失音等肺系实热病证（A错）。照海主治失眠、癫痫等神志病证；咽喉干痛、目赤肿痛等五官热性病证；月经不调、痛经、带下阴挺等妇科病证；小便频数，癃闭（C错）。中渚主治头痛、目赤、耳鸣、耳聋、喉痹等头面五官病证；热病、疟疾；肩背肘臂酸痛，手指不能屈伸（D错）。后溪主治头项强痛、腰背痛、手指及肘臂挛痛等痛证；耳聋、目赤；癫狂病；疟疾（E错）。